依据《中华人民共和国药品管理法实施条例》的规定，对集中规模化栽培养殖、质量可以控制并符合国务院药品监督管理部门规定的条件，可以实行批准文号管理的是
A. 中药材品种
B. 预防性生物制品
C. 非药品
D. 中药饮片
E. 血液制品

正确答案：A。中药材品种

解析：本题考查中药材品种。依据《中华人民共和国药品管理法实施条例》的规定，对集中规模化栽培养殖、质量可以控制并符合国务院药品监督管理部门规定的条件，可以实行批准文号管理的是中药材品种（A对）。